过量服用可出现认知功能障碍、痴呆等不良反应的饮片是
A. 蓖麻子
B. 白矾
C. 苦杏仁
D. 香加皮
E. 胆矾

正确答案：B。白矾

解析：本题考查的是中药饮片的不良反应。过量服用可出现认知功能障碍、痴呆等不良反应的饮片是白矾（B对）。白矾的不良反应表现：（1）急性中毒：大剂量内服可引起口腔、喉头烧伤，呕吐腹泻，虚脱，甚至死亡。曾有文献报道1例重度硫酸铝钾（白矾中的主要成分）中毒，患者表现为心率增快、心电图T波高尖（高钾血症导致），血压降低，上腹部烧灼样痛，尿少及严重腹泻。（2）慢性中毒：慢性中毒主要为白矾中的铝离子长期摄入导致的蓄积反应，表现如下。①神经毒性：阿尔茨海默病、痴呆和认知功能障碍。②骨骼：骨软化和骨营养不良。③肝肾功能损伤：动物试验证实铝蓄积可导致肝肾功能损伤。④血液系统：非缺铁性的小细胞低色素性贫血等。蓖麻子（A错）的不良反应表现：蓖麻毒素经呼吸道吸入、消化道摄入和肌内注射均可致人中毒，潜伏期一般为4～8小时，临床主要表现如下。①消化系统：口麻、咽部烧灼感、恶心、呕吐、腹痛、腹泻、出血性胃肠炎，黄疸以及中毒性肝病等。②呼吸、循环系统：呼吸、循环衰竭。③网状内皮系统：严重脱水、低蛋白血症、水肿、毒血症、高热。④血液、泌尿系统：溶血；血便、血尿、少尿、尿闭等中毒性肾病。⑤神经系统：四肢麻木、步态不稳、烦躁不安、精神错乱、手舞足蹈、昏迷、幻觉、癫痫样发作。⑥有时可伴发过敏反应如口唇青紫、荨麻疹。苦杏仁（C错）的不良反应表现：苦杏仁的主要成分苦杏仁苷是其有效成分也是中毒成分，误服过量苦杏仁可发生氢氰酸中毒，使延髓等生命中枢先抑制后麻痹，并抑制细胞色素氧化酶的活性而引起组织窒息。临床表现为眩晕、心悸、恶心、呕吐等中毒反应，重者出现昏迷、惊厥、瞳孔散大、对光反应消失，最后因呼吸麻痹而死亡。香加皮（D错）的不良反应表现：①消化系统：主要为恶心、呕吐、腹泻等胃肠道症状。②心血管系统：主要为心律失常，如心率减慢、早搏、房室传导阻滞等。动物毒性实验表明香加皮中毒后多表现为血压先升而后下降、心肌收缩力增强、每分钟心输出量增加，继而心输出量减弱、心律失常，乃至心肌纤颤而死亡。胆矾（E错）的不良反应表现：①消化系统：流涎、恶心、呕吐、腹痛、腹泻、呕血、便血等，口涎、呕吐物、粪便多呈蓝绿色，口中有特殊金属味；黄疸、中毒性肝炎等症状。②血液系统：溶血性贫血。③泌尿系统：蛋白尿、血尿、少尿、无尿、氮质血症、急性肾功能衰竭或尿毒症等。④循环系统：血管麻痹、血压下降。铜离子对心脏损害可引起中毒性心肌炎，表现心动过速、心律失常及心力衰竭。⑤神经系统：头痛头晕、全身乏力，严重者出现脑水肿、痉挛、神经麻痹、谵妄、意识障碍等中毒性脑炎症状。